关于药物在滴丸基质中分散状态的叙述，错误的是
A. 形成固体溶液
B. 形成胶团
C. 形成微细结晶、亚稳定型结晶或无定型粉末
D. 形成固态凝胶
E. 形成固态乳剂

正确答案：B。形成胶团